休克初期（微循环缺血性缺氧期）组织微循环灌流的特点是
A. 多灌少流，灌多于流
B. 不灌不流，灌少于流
C. 少灌少流，灌少于流
D. 少灌少流，灌多于流
E. 多灌多流，灌少于流

正确答案：C。少灌少流，灌少于流

解析：少灌少流，灌少于流（C对ABDE错），组织呈缺血缺氧状态是休克初期（微循环缺血性缺氧期）组织微循环灌流的特点。